属于一级信息资源的有
A. 《中国药学杂志》
B. 《新编药物学》
C. 《中国药学文摘》
D. 《中国医院药学杂志》
E. 《中国执业药师》杂志

正确答案：A、D、E。《中国药学杂志》；《中国医院药学杂志》；《中国执业药师》杂志

解析：本题考查药物信息的分类。《中国药学杂志》（A对）、《中国医院药学杂志》（D对）、《中国执业药师》（E对）杂志均属于一级信息资源。《新编药物学》（B错）属于三级信息资源。《中国药学文摘》（C错）属于二级信息资源。药学信息按照其最初来源通常分为三级：一级信息资源（一次文献）即原创性论著；二级信息资源（二级文献）是对原创性论著进行加工，主要用于检索一级文献；三级信息资源（三次文献）是在一级、二级文献的基础上归纳、综合、整理后的结果。